评价药物吸收程度的药动学参数是
A. 药-时曲线下面积
B. 清除率
C. 消除半衰期
D. 药峰浓度
E. 表观分布容积

正确答案：A。药-时曲线下面积

解析：本题考查评价药物吸收程度的药动学参数。药-时曲线下面积（A对）与药物吸收的总量成正比，反映药物的吸收程度；清除率（B错）是评价药物消除快慢的参数；消除半衰期（C错）是反映体内药物消除速度的参数；药峰浓度（D错）系指血药浓度-时间曲线上的最大血药浓度值；表观分布容积（E错）是表示药物分布特征的参数。